肝功能障碍时容易出血的原因是
A. 肝素产生增多
B. 纤溶酶产生增多
C. 凝血因子产生减少
D. 毛细血管壁受损
E. FDP增多

正确答案：C。凝血因子产生减少

解析：大部分凝血因子（A对）都由肝细胞合成，重要的抗凝物质褥蛋白C、抗凝血酶-3等也有肝细胞合成，肝细胞还合成纤溶酶原、抗纤溶酶等；此外，很多激活的凝血因子和纤溶酶原激活物等也由肝细胞清除，因此肝功障碍时可致机体凝血与抗凝平衡紊乱，严重时可诱发DIC。